患者，女，23岁，已婚。妊娠7个月，面浮肢肿，下肢尤甚，心悸气短，腰酸无力，舌淡苔薄润，脉沉细。其诊断是
A. 妊娠肿胀脾虚证
B. 妊娠肿胀肾虚证
C. 妊娠肿胀气滞证
D. 胎动不安肾虚证
E. 以上均非

正确答案：B。妊娠肿胀肾虚证

解析：患者妊娠7个月，面浮肢肿，下肢尤甚，心悸气短，腰酸无力，是因为其肾气虚上不能温煦脾阳，运化水湿；下不能温煦膀胱，化气行水；水道莫制，泛溢肌肤；湿性重浊，故肿势下肢尤甚；腰酸乏力，舌淡苔薄润，脉沉细均为肾虚之征（B对）。妊娠肿胀脾虚证多为面目四肢浮肿，或遍及全身，皮薄光亮，按之凹陷不起，面色晄白无华，并伴有神疲气短懒言，口淡而腻脘腹胀满等脾虚症状（A错）。妊娠肿胀气滞证除肢体肿胀，始于两足，渐延于腿，皮色不变，随按随起，还伴有头晕胀痛，胸闷胁胀等气滞症状（C错）。胎动不安肾虚证多为妊娠期阴道少量出血，色淡黯，腰酸、腹痛、下坠，或曾屡孕屡堕，并伴有头晕耳鸣，夜尿多，眼眶黯黑或面部有黯斑等肾虚症状（D错）。